血浆脂蛋白按照超速离心法可分为
A. CM、VLDL、HDL三类
B. CM、VLDL、LDL和HDL四类
C. CM、β-脂蛋白、α-脂蛋白三类
D. CM、VLDL、前β-脂蛋白和α-脂蛋白四类
E. CM、前β-脂蛋白、β-脂蛋白和α-脂蛋白四类

正确答案：B。CM、VLDL、LDL和HDL四类